身热，心烦不寐，舌红苔黄，脉细数治疗宜选用
A. 黄连阿胶汤
B. 青蒿鳖甲汤
C. 栀子豉汤
D. 清营汤
E. 翘荷汤

正确答案：A。黄连阿胶汤

解析：“身热，心烦不寐，舌红苔黄，脉细数”为春温后期，邪热久羁耗伤肾阴，心火亢盛所致。春温后期，邪热久羁，水亏火旺，水火不能相济，火愈亢而阴愈伤，阴愈亏而火愈炽。阴虚火炽则身热； 心火上炎，扰乱心神，则心烦不寐；舌红苔黄、脉细数是阴虚火炽之征，故治以清热降火，育阴安神，方选黄连阿胶汤（A对）。方中以黄连、黄芩苦寒清热，泻心火，坚真阴；鸡子黄交通心肾，养心而滋肾，安中焦，补精血；阿胶、白芍滋肝肾，养真阴，抑亢阳。